男，24岁。因体检发现心律不齐1周就诊。平素无心悸和头晕。既往体健。查体：BP110/60mmHg，心界不大，心律不齐，可闻及早搏2次/分。心电图室性期前收缩。超声心动图提示心脏结构正常。该患者最适宜的处理措施是
A. 继续随访，暂不予药物治疗
B. 口服ⅠC类抗心律失常药物
C. 口服自受体拮抗剂
D. 口服ⅠB类抗心律失常药物
E. 口服Ⅲ类抗心律失常药物

正确答案：A。继续随访，暂不予药物治疗

解析：患者男，24岁，平素无心悸和头晕。体检时发现血压110/60mmHg，心律不齐，超声心动图提示心脏结构正常，可判断无器质性病变。心电图示室性期前收缩，正常人可发生室性期前收缩，无其他明显症状，不必使用药物治疗（A对BCDE错）。